心影呈梨型见于
A. 左心房增大，肺动脉段膨出
B. 左心室、右心室増大
C. 右心室増大
D. 右房右室大
E. 主动脉弓膨出

正确答案：A。左心房增大，肺动脉段膨出

解析：心影呈梨形见于左心房增大或合并肺动脉段扩大，左心房增大，肺动脉段膨出（A对），左、右心室增大称普大型，见于扩张型心肌病（B错）。